床位不满100张的医疗机构，其《医疗机构执业许可证》
A. 每1年校验1次
B. 每2年校验1次
C. 每3年校验1次
D. 每4年校验1次
E. 每1年校验2次

正确答案：A。每1年校验1次

解析：床位在100张以上的综合医院、中医医院、中西医结合医院、民族医医院以及专科医院、疗养院、康复医院、妇幼保健院、急救中心、临床检验中心和专科疾病防治机构，其《医疗机构执业许可证》每3年校验1次。床位不满100张的医疗机构，其《医疗机构执业许可证》每年校验1次。掌握“医疗机构登记和校验及法律责任”知识点。